又称指状舌尖的
A. 畸形舌侧窝
B. 畸形唇面
C. 畸形根面沟
D. 畸形舌侧尖
E. 牙中牙

正确答案：D。畸形舌侧尖

解析：畸形舌侧尖：除舌侧窝内陷外，舌隆突呈圆锥形突起，有时突起成一牙尖，又称指状舌尖。牙髓组织亦随之进入舌侧尖内，形成纤细髓角，易遭磨损而引起牙髓及根尖周组织病变。掌握“牙内陷”知识点。